属于选择性5-HT再摄取抑制剂的药物是
A. 丙咪嗪
B. 氟西汀
C. 马普替林
D. 吗氯贝胺
E. 苯乙肼

正确答案：B。氟西汀

解析：本题考查5-羟色胺（5-HT）再摄取抑制剂。属于选择性5-HT再摄取抑制剂的药物是氟西汀（B对）。氟西汀为选择性的5-羟色胺重摄取抑制剂，通过选择性地抑制中枢神经系统对5-HT的再吸收，延长和增加5-HT的作用。丙咪嗪（A错）为三环类抗抑郁药，该类药主要通过抑制神经末梢对NE和5-HT的再摄取，减少NE和5-HT的氧化脱氨代谢，增加突触间隙的NE和5-HT浓度，促进神经传递。马普替林（C错）为选择性去甲肾上腺素重摄取抑制剂，对5-HT几乎没有作用，是广谱的抗抑郁药。吗氯贝胺（D错）为单胺氧化酶抑制剂类抗抑郁药，其作用是通过可逆性抑制A型单胺氧化酶，从而提高脑内去甲肾上腺素、多巴胺和5-羟色胺的水平，起到抗抑郁作用。苯乙肼（E错）用于治疗抑郁症，尤其是反应性抑郁症，为不可逆单胺氧化酶抑制剂，无选择性。